男性，10岁，双腮腺反复肿胀3年，每年肿胀4～5次，每次持续1周，无口干、眼干症状，腮腺造影有点球状扩张，合适的处理为
A. 理疗
B. 多饮水，按摩腺体，保持口腔卫生，必要时抗感染治疗
C. 应行双腮腺手术切除
D. 腮腺内注入甲紫致腺体萎缩
E. 主导管结扎治疗

正确答案：B。多饮水，按摩腺体，保持口腔卫生，必要时抗感染治疗

解析：本题考查慢性复发性腮腺炎。此患儿双腮腺反复肿胀3年，每年肿胀4～5次，每次持续1周，无口干、眼干症状，腮腺造影有点状及球状扩张，这些临床表现均是儿童复发性腮腺炎的特征。本病多发生于儿童，儿童期免疫系统发育不成熟，免疫功能低下，易发生逆行性感染，待患儿发育成熟后可以自愈。合适的处理为多饮水，按摩腺体，保持口腔卫生，必要时抗感染治疗（B对）。